具有腐败臭鸡蛋味的气体是
A. 硫化氢
B. 氰化氢
C. 一氧化碳
D. 苯胺

正确答案：A。硫化氢

解析：本题考查硫化氢的理化性质。硫化氢（A对BCD错）（H₂S）是一种易燃、无色并具有强烈腐败臭鸡蛋气味的气体，易积聚在低洼处。H₂S易溶于水生成氢硫酸。呈酸性反应，能与大部分金属反应形成黑色硫酸盐。